邪正盛衰决定着
A. 病证的寒热
B. 病位的表里
C. 气血的虚实
D. 病证的虚实
E. 脏腑的虚实

正确答案：D。病证的虚实

解析：本题考查的是邪正盛衰与虚实变化。邪正盛衰决定着病证的虚实（D对）。邪正盛衰的病机，是指在疾病过程中，机体的抗病能力与致病邪气之间相互斗争中所发生的盛衰变化。这种斗争，不仅关系着疾病的发生，而且直接影响着疾病的发展和转归，同时也影响着病证的虚实变化。在疾病的发展过程中，邪正的消长盛衰变化决定病机、病证的虚实夹杂或转化。一般规律是，正盛邪退则病势好转或向愈，邪去正虚则病愈而体虚，正虚邪恋则病势缠绵迁延而难愈，邪盛正衰则病势恶化，甚则死亡。病证的寒热（A错）由阴阳失调病机决定。阴阳失调病机，是以阴阳的属性，阴和阳之间所存在的相互制约、相互消长、互根互用和相互转化的理论，来阐释、分析、综合机体一切病变现象的机制，形成了阴阳偏盛偏衰、阴阳互损、阴阳格拒、阴阳亡失等病机的概念及以寒热变化为主的证候。气血的虚实（C错）由气血失调病机决定。人体生命活动的进行，主要是依靠后天所化生的气血津液，通过经脉输布于全身，营养各个脏腑组织器官而实现的。人体的气血是脏腑经络等组织器官进行功能活动的物质基础，若气血津液失常，必然会影响机体的各种生理功能，从而导致疾病的发生。同时，气与血又是脏腑气化活动的产物，因此，脏腑发生病变，不但可以引起本脏腑之气血失常，而且也会影响全身的气血，导致全身气和血的病变变化。所以，气血津液失常不仅是脏腑、经络、形体、官窍等各种病机变化的基础，而且亦是分析和研究各种临床病证病机的基础。